变形链球菌致龋的特征是能使蔗糖形成
A. 不溶性细胞外多糖
B. 可溶性细胞内多糖
C. 不溶性细胞内多糖
D. 可溶性细胞外多糖

正确答案：A。不溶性细胞外多糖

解析：本题考查糖的合成代谢。变形链球菌致龋的特征是能使蔗糖形成不溶性细胞外多糖（A对）。非水溶性葡聚糖为变异链球菌的胞外聚合物，其具有很强的黏性，在细菌的黏附过程中有着重要的作用，是变异链球菌的主要毒力因素之一，具有较强的致龋性。水溶性的葡聚糖易溶于水，致龋作用相对较低（D错）。